溃疡性结肠炎患者典型的粪便特征是
A. 柏油样便
B. 陶土样便
C. 鲜血便
D. 稀水样便
E. 黏液脓血便

正确答案：E。黏液脓血便

解析：黏液脓血便（E对）及腹泻是溃疡性结肠炎的主要临床表现，其中粘液脓血便是本病活动期的重要标志。柏油样便（A错）是上消化道出血的主要临床表现。陶土样便（B错）主要见于胆道梗阻。鲜血便（C错）主要鉴于下消化道出血。稀水样便（D错）主要见于轮状病毒感染。